牙髓病的分类中，根据组织病理学的表现分类，不包括
A. 牙髓充血
B. 髓石
C. 生理性牙髓充血
D. 慢性溃疡性牙髓炎
E. 急性浆液性牙髓炎

正确答案：B。髓石

解析：髓石是根据牙髓病的临床表现和治疗预后进行分类的。掌握“牙髓疾病的病因及分类”知识点。